有高血压的内分泌疾病中，尿儿茶酚胺增多见于
A. 甲状腺功能亢进症
B. 库欣综合征
C. 肢端肥大症
D. 原发性醛固酮增多症
E. 嗜铬细胞瘤

正确答案：E。嗜铬细胞瘤

解析：嗜铬细胞瘤起源于肾上腺髓质、交感神经节和体内其他部位嗜铬组织，这种瘤持续或间断地释放大量儿茶酚胺，引起持续性或阵发性高血压和多个器官功能及代谢紊乱。因此有高血压的内分泌疾病中，尿儿茶酚胺增多见于嗜铬细胞瘤（E对）。甲状腺功能亢进症（A错）血清TSH（促甲状腺激素）减少，而甲状腺激素增多。库欣综合征（B错）为尿游离皮质醇、17-羟皮质类固醇和17-酮类固醇增多。肢端肥大症（C错）为体内生长激素分泌过多所致，一般不会导致尿儿茶酚胺增多。原发性醛固酮增多症（D错）中血浆、尿醛固酮皆增高，与儿茶酚胺无关。